CO中毒脑水肿治疗首选药物是
A. 地西泮
B. 地塞米松
C. 胞磷胆碱
D. 甘露醇
E. 血管扩张剂

正确答案：D。甘露醇

解析：一氧化碳中毒的机制在于其所导致的机体组织器官缺氧，其中又以神经系统症状最为明显突出。临床表现上，轻度中毒患者可以表现为头晕，头痛，耳鸣，肢体无力，恶心，呕吐等表现；中重度中毒患者可以表现为意识模糊，认知能力下降，四肢厥冷，口唇甲床苍白发绀，甚至出现昏迷抽搐，严重者可于短期内造成死亡。甘露醇用于治疗各种原因引起的脑水肿，降低颅内压，防止脑疝，也可有效降低眼内压，应用于其他降眼内压药无效时或眼内手术前准备（D对）；一般的抽搐急救的首选药品是地西泮，它主要起镇静和控制抽搐的作用（A错）；地塞米松是一种肾上腺皮质激素药，主要用于抗炎、抗过敏、免疫抑制、抗中毒和抗休克等（B错）；胞磷胆碱是一种核苷的衍生物，能增强上行网状结构激动系统的功能。临床用于颅脑手术和脑外伤引起的意识障碍（C错）；血管扩张剂是周围血管疾病中，用于治疗闭塞性和痉挛性疾病最为重要的一类临床用药（E错）。